有关婚育问题的咨询内容包括
A. 对生殖健康有疑问、准备结婚的男女和新婚夫妇
B. 是“暂缓结婚”问题和“不宜生育”问题
C. 做好孕前准备，包括受孕时机、受孕季节的选择、夫妇双方的健康、心理、环境等因索的准备，同时要消除不利受孕因素的影响，如戒烟、戒酒、避免有害物理化学因素的接触，掌握受孕的方法如基础体温测量法、日程推算法、宫颈黏液观察法
D. 为服务对象保密，尊重服务对象的隐私权
E. 保证任何一位要求结婚生育的男女青年的要求

正确答案：B。是“暂缓结婚”问题和“不宜生育”问题

解析：本题考查有关婚育问题的咨询内容。有关婚育问题的咨询内容是“暂缓结婚”问题和“不宜生育”问题（B对ACDE错），坚待有利不伤害的原则，使他们在婚检后能够理智地和自主地做出决定，选择有利于婚姻、生殖和自身健康的行为，做到需要与自愿的最佳结合。